与大脑小脑的发育有关
A. 大脑皮质
B. 前庭神经核
C. 脊髓小脑束
D. 间脑
E. 端脑

正确答案：A。大脑皮质

解析：大脑小脑与大脑皮质同步发展，且与大脑皮质构成纤维联系环路，因而大脑皮质（A对）与大脑小脑的发育有关。